下列关于紫外线杀菌的描述中，不正确的是
A. 干扰DNA正常碱基配对
B. 紫外线杀菌的有效波长为240～280nm
C. 不能用于微生物的灭活
D. 对人体皮肤和眼睛有损伤作用
E. 紫外线消毒的特点是穿透力强

正确答案：E。紫外线消毒的特点是穿透力强

解析：紫外线杀菌的原理是使细菌DNA链上相邻的嘧啶碱基形成嘧啶二聚体，从而干扰DNA正常碱基配对，导致细菌死亡或突变。紫外线杀菌的有效波长为240～280nm，其中以波长为265～266nm杀菌作用最强。紫外线消毒的特点是穿透力差，且需照射30分钟～1小时才有效，仅适于直射物品表面消毒及对空气的消毒，尤其不能用于微生物的灭活处理，以免被激活后，微生物复活。紫外线对人体皮肤和眼睛有损伤作用，应注意防护。掌握“消毒与灭菌”知识点。